下列关于回盲瓣的说法，正确的是
A. 由盲肠突入回肠形成
B. 由该处肠壁内的纵层肌
C. 由回肠突入盲肠形成
D. 形状如环行
E. 位于回肠上端

正确答案：C。由回肠突入盲肠形成

解析：回盲瓣由回肠突入盲肠形成(A错C对，为本题正确答案)，由该处肠壁内的环行肌(B错)，形状为半月形(D错)，位于回肠末端(E错)。